常在传染病学恢复期出现，持续时间较长的抗体是
A. IgA
B. IgD
C. IgE
D. IgG
E. IgM

正确答案：D。IgG

解析：IgG为恢复期抗体，持续时间长，多用于回顾性诊断和流行病学调查（D对）。IgA主要是呼吸道和消化道黏膜上的局部抗体（A错）。检测机体IgD的含量可了解机体的体液免疫功能状态，帮助诊断免疫增生、免疫缺陷、感染及自身免疫性等多种疾病，具有重要的临床意义（B错）。IgE则主要作用于人侵的原虫和蠕虫（C错）。在感染过程中IgM首先出现，但持续时间不长，是近期感染的标志（E错）。